属于两性离子型表面活性剂的是
A. 司盘20
B. 十二烷基苯磺酸钠
C. 苯扎溴铵
D. 卵磷脂
E. 吐温80

正确答案：D。卵磷脂

解析：本题考查表面活性剂。卵磷脂（D对）为天然的两性离子表面活性剂；司盘20（A错）即脱水山梨醇月桂酸酯，是非离子表面活性剂；十二烷基苯磺酸钠（B错）是阴离子表面活性剂；苯扎溴铵（C错）是阳离子表面活性剂；吐温80（E错）即聚氧乙烯脱水山梨醇单油酸酯，是非离子表面活性剂。